患者，男，78岁。经常气短，呼吸困难，最近出现头痛，烦躁不安，渐至言语不清，昏迷，于今日入院。查体：肺部叩诊呈过清音，心浊音界缩小，肝浊音界下降，应首先考虑的是
A. 结核性脑膜炎
B. 肺心病
C. 脑出血
D. 肺性脑病
E. 精神病

正确答案：D。肺性脑病

解析：根据症状和体征知患者出现了神志病变以及肺部病变，应首先考虑的是肺性脑病（D对）。结核性脑膜炎（A错）表现有结核中毒症状，脑膜刺激征和颅内压增高表现，若早期未能及时治疗会有脑实质损害、脑神经损害；肺心病（B错）肺心功能代偿期表现为慢性阻塞性肺疾病；肺心功能失代偿期主要表现以呼吸衰竭为主，有或无心力衰竭。脑出血（C错）表现为头痛剧烈，常见呕吐，出血后血压明显升高，重症者迅速转为意识模糊或昏迷、精神病（E错）指严重的心理障碍，患者的认识、情感、意志、动作行为等心理活动会出现持久的明显的异常，不能正常的学习、工作或生活，动作行为难以被一般人理解，在病态心里的支配下，有自杀或攻击、伤害他人的动作行为。以上均不会有呼吸系统症状的出现。